药物以离子状态分散在分散介质中所构成的体系属于
A. 溶液型
B. 胶体溶液型
C. 乳浊型
D. 混悬型
E. 固体分散型

正确答案：A。溶液型

解析：本题考查药物剂型的分类。药物以离子状态分散在分散介质中所构成的体系属于溶液型（A对）。溶液型是药物以分子或离子状态分散于分散介质中形成的体系。胶体溶液型（B错）主要是以高分子分散于分散介质中所形成的体系。乳浊型（C错）体系中油类药物或药物油溶液以液滴状存在。混悬型（D错）体系中固体药物以微粒状态存在。固体分散型（E错）体系中固体药物以聚集状态存在。